关于硬脊膜的说法，哪一种不正确
A. 上端在枕骨大孔处与硬脑膜相续
B. 与椎管内骨膜隔以硬膜外隙
C. 在第1腰椎体的下缘紧包终丝，附着于尾骨
D. 在椎间孔处与脊神经被膜相连续
E. 无

正确答案：C。在第1腰椎体的下缘紧包终丝，附着于尾骨

解析：硬脊膜为脊髓最外层的被膜，上端在枕骨大孔处与硬脑膜相续（A对），下端在第2骶椎水平紧包终丝，附着于尾骨（C错，为本题正确答案）。硬脊膜与椎管内骨膜隔以硬膜外隙（B对），内含疏松结缔组织、脂肪、淋巴管、静脉丛和脊神经根等。在椎间孔处，硬脊膜与脊神经被膜相连续（D对）。